识别抗原，并把识别信号传递到B细胞的是
A. TCR-CD3复合物
B. mlg
C. FcR
D. C3bR
E. BCR复合物

正确答案：E。BCR复合物